收集胸、腹壁后部的静脉血
A. 内眦静脉
B. 头静脉
C. 奇静脉
D. 附脐静脉
E. 大隐静脉

正确答案：C。奇静脉

解析：奇静脉（C对）收集右侧肋间静脉、食管静脉、支气管静脉和半奇静脉的血液，即胸、腹壁后部的静脉血。